采用紫外分光光度法测定氯氮卓片的含量时，在308nm处测得供试品溶液的吸收度为0.638，已知氯氮卓在308nm处的吸收系数为319，则供试品溶液的浓度为
A. 0.005g100ml
B. 0.005g/ml
C. 0.02g/100ml
D. 0.002g/ml
E. 0.002g/100ml

正确答案：E。0.002g/100ml